五输穴中所行为
A. 井
B. 荥
C. 输
D. 经
E. 合

正确答案：D。经

解析：该题考查五输穴的特点。井穴为经气初出，故所出为井（A错）。荥穴为经气开始流动，故所溜为荥（B错）。输穴为经气由浅入深，故所注为输（C错）。经穴为经气盛大流行，故所行为经（D对）。合穴为经气充盛且入合于脏腑（E错）。